输卵管结扎术常选部位在
A. 输卵管腹腔口
B. 输卵管子宫部
C. 输卵管峡
D. 输卵管壶腹
E. 无

正确答案：C。输卵管峡

解析：输卵管腹腔口（A错）开口于腹膜腔，卵巢排出的卵子由此进入输卵管；输卵管子宫部（B错）以输卵管子宫口通子宫腔；输卵管峡（C对）是输卵管结扎术施行部位；输卵管壶腹（D错）是卵子受精的部位。